关于影响乳牙早失后间隙变化的因素，描述哪项是错误的
A. 乳切牙早失，间隙变小或消失的较少
B. 乳尖牙早失，间隙极易变小
C. 乳牙丧失时年龄越小，邻牙倾斜的机会越多
D. 乳牙接近脱落时拔除，邻牙倾斜的机会越多
E. 牙列严重拥挤时牙齿向缺牙间隙移动会很快

正确答案：D。乳牙接近脱落时拔除，邻牙倾斜的机会越多

解析：本题考查影响乳牙早失后间隙变化的因素。乳牙接近脱落时拔除，邻牙倾斜移位的机会越小（D错，为本题的正确答案），因为乳牙拔除后不久继承恒牙便会萌出，会减少邻牙移位的机会。前牙区牙槽骨增长显著，乳切牙早失，间隙变小或消失的可能性较小（A对）。乳尖牙早失，间隙极易变小（B对），致使恒尖牙异位萌出。乳牙丧失时年龄越小，邻牙倾斜的机会越多（C对）。牙列越拥挤，牙齿向缺牙间隙移动越快（E对），间隙变小的可能性就越大。